必须由具有蛋白同化制剂、肽类激素定点批发资质的药品批发企业从事批发业务的产品是
A. 药品类易制毒化学品
B. 含麻黄碱类复方制剂
C. 第三类易制毒化学品
D. 含可待因复方口服液体制剂

正确答案：B。含麻黄碱类复方制剂

解析：本题考查含麻黄碱类复方制剂的管理。必须由具有蛋白同化制剂、肽类激素定点批发资质的药品批发企业从事批发业务的产品是含麻黄碱类复方制剂（B对）。含麻黄碱类复方制剂的经营行为管理：1.具有蛋白同化制剂、肽类激素定点批发资质的药品经营企业，方可从事含麻黄碱类复方制剂的批发业务。2.严格审核含麻黄碱类复方制剂购买方资质，购买方是药品批发企业的必须具有蛋白同化制剂、肽类激素定点批发资质。药品零售企业应从具有经营资质的药品批发企业购进含麻黄碱类复方制剂。药品批发企业销售含麻黄碱类复方制剂时，应当核实购买方资质证明材料、采购人员身份证明等情况，核实无误后方可销售，并跟踪核实药品到货情况，核实记录保存至药品有效期后一年备查。3.除个人合法购买外，禁止使用现金进行含麻黄碱类复方制剂交易。4.发现含麻黄碱类复方制剂购买方存在异常情况时，应当立即停止销售，并向有关部门报告。生产、经营药品类易制毒化学品（AC错）的企业，应当依照有关规定取得药品类易制毒化学品生产、经营许可。未取得生产许可或经营许可的企业不得生产或经营药品类易制毒化学品。申请经营药品类易制毒化学品原料药的药品经营企业，应具有麻醉药品和第一类精神药品定点经营资格或者第二类精神药品定点经营资格，否则，药品监督管理部门将不予受理。自2015年5月1日起，不具备第二类精神药品经营资质的企业不得再购进含可待因复方口服液体制剂（D错）。